互联网药品信息服务分为
A. 处方药与非处方药两类
B. 一般药品与特殊药品两类
C. 面向公众与面向专业人员两类
D. 经营性与非经营性两类
E. 面向国内与面向国外两类

正确答案：D。经营性与非经营性两类

解析：本题考查互联网药品信息服务。互联网药品信息服务分为经营性和非经营性（D对）两类。经营性互联网药品信息服务是指通过互联网向上网用户有偿提供药品信息等服务的活动。非经营性互联网药品信息服务是指通过互联网向上网用户无偿提供公开的、共享性药品信息等服务的活动。